治疗病毒感染可选用的药物是
A. 左旋咪唑
B. 氯米芬
C. 环孢素
D. 干扰素
E. 垂体后叶素

正确答案：D。干扰素

解析：本题考查抗病毒药。治疗病毒感染可选用的药物是干扰素（D对）。干扰素（IFN）具有广谱抗病毒作用，抑制蛋白质合成是其对许多病毒的主要作用。IFN主要用于治疗慢性病毒性肝炎（乙、丙、丁型）；亦可用于尖锐湿疣、生殖器疱疹以及HIV患者的卡波济肉瘤。左旋咪唑（A错）为广谱驱肠虫药。氯米芬（B错）为抗雌激素类药。环孢素（C错）为免疫抑制剂。垂体后叶素（E错）为包括缩宫素与升压素。缩宫素主要用于引产、产后子宫收缩不良和产后止血。升压素又称抗利尿激素（ADH），主要用于治疗尿崩症，在大量肺咯血时用作止血剂。